正确描述尺神经的是
A. 发自颈丛
B. 经肱骨内上髁与尺骨鹰嘴之间转入前臂
C. 经肘窝到前臂
D. 仅分布于前臂大部分屈肌
E. 分布于前臂小部分伸肌

正确答案：B。经肱骨内上髁与尺骨鹰嘴之间转入前臂

解析：尺神经发自臂丛（A错），经肱骨内上髁与尺骨鹰嘴之间转入前臂（B对C错），尺神经在臂部不发任何分支，在前臂上部发肌支支配尺侧腕屈肌和指深屈肌尺侧半（DE错）。